用于长循环脂质体表面修饰的材料是
A. 明胶与阿拉伯胶
B. 西黄蓍胶
C. 磷脂与胆固醇
D. 聚乙二醇
E. 半乳糖与甘露糖

正确答案：D。聚乙二醇

解析：本题考查脂质体。聚乙二醇（PEG）（D对）修饰可增加脂质体的柔顺性和亲水性，从而降低与单核巨噬细胞的亲和力，延长循环时间，称为长循环脂质体。长循环脂质体有利于对肝脾以外的组织或器官的靶向作用。同时，将抗体或配体结合在PEG的末端，既可保持长循环，又可保持对靶点的识别。明胶与阿拉伯胶（A错）为天然高分子囊材。磷脂与胆固醇（C错）是制备普通脂质体的材料。